对药品分别按处方药与非处方药进行管理是根据药品的
A. 品种
B. 规格
C. 适应证
D. 剂量
E. 给药途径

正确答案：A、B、C、D、E。品种；规格；适应证；剂量；给药途径

解析：本题考查处方药和非处方药。对药品分别按处方药与非处方药进行管理是根据药品的品种（A对）、规格（B对）、适应证（C对）、剂量（D对）及给药途径（E对）。